β受体激动药引起的效应是
A. 支气管平滑肌收缩
B. 心脏兴奋
C. 骨骼肌血管收缩
D. 糖原合成
E. 瞳孔缩小

正确答案：B。心脏兴奋